患者50岁，因鼻咽癌外院放疗结束后2年，来门诊就诊。检查：全口多个牙齿牙面不同程度龋，部分患牙已成残冠，残根，口内唾液较少，牙面及龈沟软垢多。该患者的诊断为猛性龋。治疗设计有以下几项，除了
A. 设计治疗全口龋齿
B. 牙髓病变的牙齿牙髓治疗
C. 拔出残根、残冠
D. 再矿化辅助治疗
E. 定期复查

正确答案：C。拔出残根、残冠

解析：本题考查猛性龋的治疗。该患者的诊断为猛性龋。治疗设计有以下几项，除了拔出残根、残冠（C错，为本题的正确答案）。猛性龋病变发展较快，且有放射治疗史，治疗时应设计治疗全口龋齿（A对）；牙髓病变的牙齿应尽早做牙髓治疗（B对）；拔除不能保留的残根、残冠，对于能够保留的残根、残冠进行牙髓治疗，做桩核冠修复；对于病变较轻的早期龋损和应用再矿化辅助治疗（D对）；患者应定期复查，以便及时发现新的龋坏，及时治疗（E对）。